预防细菌性痢疾综合措施的不包括
A. 切断传播途径
B. 应尽早发现并治疗患者
C. 改善环境及搞好个人卫生
D. 服用痢疾减毒活菌苗
E. 肌注抗菌疫苗

正确答案：E。肌注抗菌疫苗

解析：细菌性痢预防措施：①管理传染源，应尽早发现并治疗患者，隔离治疗至症状消失后1周或粪便培养两次阴性。从事饮食、供水等服务行业人员应定期作粪便培养，发现带菌者应积极治疗并暂时调离工作岗位。②切断传播途径，加强饮水、食品、粪便的卫生管理和消灭苍蝇，改善环境及搞好个人卫生。③保护易感人群，口服多价痢疾减毒活菌苗，可刺激肠黏膜产生特异性分泌型抗体IgA，免疫力可维持6～12个月。掌握“细菌性痢疾”知识点。